患者，男，83岁，2个月前诊断为缺血性脑卒中，目前卧床，需鼻饲给药，肝、肾功能尚正常，既往心房颤动病史5年，未规律治疗。宜选用的药品是
A. 达比加群酯
B. 利伐沙班片
C. 替格瑞洛片
D. 阿司匹林肠溶片
E. 注射用尿激酶

正确答案：B。利伐沙班片

解析：本题考查心房颤动的药物治疗。对于不能整片吞服的患者，利伐沙班（B对）可以碾碎、鼻饲服用。该患者目前卧床、鼻饲给药，选用抗凝药物达比加群酯（A错）进行治疗，在服用时请勿打开胶囊，避免药物吸收过多导致出血风险升高，故不宜选用。预防房颤患者血栓栓塞事件多采用抗凝治疗，替格瑞洛（C错）、阿司匹林（D错）和尿激酶（E错）不用于抗凝。